可引起膀胱炎的抗肿瘤药物是
A. 氟尿嘧啶
B. 巯嘌呤
C. 环磷酰胺
D. 博来霉素
E. 多柔比星

正确答案：C。环磷酰胺

解析：本题考查药物的不良反应。可引起膀胱炎的抗肿瘤药物是环磷酰胺（C对）。环磷酰胺本身无毒性，代谢后产生的丙烯醛会导致膀胱黏膜急性或慢性损伤，引进化学性炎症，造成膀胱广泛的出血，引起出血性膀胱炎。氟尿嘧啶（A错）的不良反应主要为对骨髓和胃肠道的毒性。巯嘌呤（B错）主要毒性为骨髓抑制。博来霉素（D错）最严重的不良反应是肺毒性，可出现间质性肺炎和肺纤维化。多柔比星（E错）最严重的不良反应是心肌退行性病变和心肌间质水肿。